结脉、促脉、代脉的共同特点是
A. 脉来较数
B. 脉来时止
C. 止无定数
D. 脉来缓慢
E. 止有定数

正确答案：B。脉来时止

解析：结脉与代脉、促脉：三者均属有歇止的脉象（B对）。其中促脉为脉数而中止，结脉为脉缓而中止，这两种歇止均不规则；代脉是脉来一止，其歇止有规则，且歇止时间较长（ACDE错）。